下颌骨骨折好发的部位中不包括
A. 正中联合部骨折
B. 髁突骨折
C. 下颌角部骨折
D. 颏孔区骨折
E. 喙突骨折

正确答案：E。喙突骨折

解析：下颌骨骨折常因不同部位骨折、不同方向的肌牵引而出现不同情况的骨折段移位，常见正中联合部骨折、颏孔区骨折、下颌角部骨折、髁突骨折。掌握“牙槽突骨折、颌骨骨折”知识点。